人感染高致病性禽流感的传播途径多为
A. 呼吸道传播
B. 消化道传播
C. 密切接触传播
D. 血液传播
E. 虫媒传播

正确答案：A。呼吸道传播